流行性感冒肆虐，传染性最强的时期为发病
A. 1天内
B. 2天内
C. 3天内
D. 5天内
E. 1周内

正确答案：C。3天内

解析：流行性感冒的病原体是流感病毒，而流感病毒的主要的传播途径是患有流感的患者的呼吸道的分泌物，通过飞沫传播到其他人的呼吸道，引起传染。流行性感冒传染性最强的时期也是患者发病初期，也就是流行性感冒发病三天以内是传染性最强的时候。这个时候患者呼吸道分泌物中含有大量的流感病毒传染性很强。很容易通过呼吸道传染到其他人（C对）。